服用感冒药期间不宜用的是
A. 左归丸
B. 越鞠丸
C. 二陈丸
D. 正天丸
E. 都梁丸

正确答案：A。左归丸

解析：本题考查左归丸的用药注意事项。服用感冒药期间不宜用的是左归丸（A对）。左归丸【注意事项】肾阳亏虚、命门火衰、阳虚腰痛者慎用。外感寒湿、跌扑外伤、气滞血瘀所致的腰痛者慎用。孕妇慎用。治疗期间，不宜食用辛辣、油腻食物。越鞠丸（B错）【注意事项】阴虚火旺者慎用。服药期间，忌忧思恼怒，避免情志刺激。二陈丸（C错）【注意事项】本品辛香温燥易伤阴津，故不宜长期服用。肺阴虚所致的燥咳、咯血忌用。服药期间，忌食辛辣、生冷、油腻食物。正天丸（D错）【注意事项】孕妇慎用。婴幼儿、哺乳期妇女、肾功能不全者，以及对本品过敏者禁用。高血压、心脏病患者，以及过敏体质者慎用。不宜过量服用或长期服用。宜饭后服用。服药期间，忌烟、酒及辛辣、油腻食物。都梁丸（E错）合理用药指导：不建议将养血清脑颗粒与四物汤联合使用，不建议将天麻头痛片与都梁丸联合使用，因皆属重复用药。